患者女性，26岁，停经45天，突感下腹坠痛及肛门坠胀感，少量阴道流血及头晕呕吐半天。体格检查：面色苍白，BP80/40mmHg，腹肌略紧张，下腹压痛。妇科检査：阴道少量血性物，宫颈举痛（+）穹窿饱满，子宫稍大，附件区触诊不满意。本例最恰当的处理是
A. 输血治疗
B. 同时手术探查纠正休克
C. 静脉输液
D. 中医治疗
E. 应用抗生素

正确答案：B。同时手术探查纠正休克

解析：本题考查异位妊娠。异位妊娠的主要症状为：停经、腹痛、阴道流血、晕厥与休克，下腹包块。考虑有内出血行后穹窿穿刺抽出不凝血，应纠正休克同时施行剖腹探查（B对）。